社会因素影响健康的基本规律是：泛影响性，恒常性，积累性和交互作用。泛影响性即作用的发散性，指一种社会因素可导致全身多个器官和系统发生下面哪种变化
A. 器质性
B. 形态学
C. 病理性
D. 功能性
E. 全部都改变

正确答案：D。功能性